阿托品的下列哪一项作用与阻断M受体无关
A. 松弛胃肠平滑肌
B. 抑制腺体分泌
C. 扩张血管，改善微循环
D. 瞳孔扩大
E. 心率加快

正确答案：C。扩张血管，改善微循环